男，24岁，突然意识不清，跌倒，全身强直数秒钟后抽搐，咬破舌。2分钟后抽搐停止。醒后活动正常。应进一步做的检查是
A. 头颅X线片
B. 脑电图
C. 脑脊液检查
D. 脑血管造影
E. 经颅超声多普勒（TCD）

正确答案：B。脑电图

解析：患者初步诊断为诊断为癫痫全面强直-阵挛发作。癫痫是由于脑部神经元异常放电引起，脑电图（B对）可以检出异常放电的部位，因而是诊断癫痫最重要的辅助检查方法。头颅X线片（A错）只能检查颅骨器质性损害，不用于癫痫的检查。癫痫患者的脑脊液检查（C错）通常是正常的。脑血管造影（D错）和经颅超声多普勒（E错）多用于辅助诊断脑血管疾病，对诊断癫痫意义不大。